有关脊髓小脑后束的描述,正确的是
A. 终止于丘脑腹后核
B. 传导深部感觉和痛、温、触觉冲动
C. 位于脊髓全长
D. 传导非意识性的深部感觉冲动
E. 在脊髓位于脊髓丘脑侧束的内侧

正确答案：D。传导非意识性的深部感觉冲动

解析：脊髓小脑后束止于小脑（A错），传导非意识性的深部感觉冲动（B错D对）。